手太阴肺经的主治特点是
A. 心病
B. 心胃病
C. 肺喉病
D. 肾病肺病咽喉病
E. 前头口齿咽喉病，胃肠病

正确答案：C。肺喉病

解析：手太阴肺经起于中焦，下络大肠，还循胃口，上膈属肺；故其主要治疗肺病、喉病（C对），如咳嗽、气喘、咽喉肿痛等，还可治疗经脉循行部位的其他病证，如肩背痛、肘臂挛痛等。手少阴心经主治心病（A错）；手厥阴心包经主治心、胃病（B错）；足少阴肾经主治肾、肺、咽喉病（D错）；足阳明胃经主治前头、口齿、咽喉、胃肠病（E错）。